关于原发性肾小球疾病的病理特点，错误的是
A. 膜性肾病是光镜下主要为不伴细胞增生的弥漫性肾小球毛细血管基底膜增厚
B. 微小病变型肾病是光镜下无明显异常，电镜下可见上皮细胞肿胀、足突广泛融合
C. 急进性肾炎主要是光镜下30%以上肾小球的肾小囊中有大新月体形成
D. 急性链球菌感染后肾小球肾炎主要是弥漫增生性肾小球炎症（内皮与系膜细胞增生）
E. 系膜增生性肾炎主要是系膜细胞及系膜基质不同程度的弥漫增生

正确答案：C。急进性肾炎主要是光镜下30%以上肾小球的肾小囊中有大新月体形成

解析：膜性肾病（膜性肾小球病）光镜下观察可见不伴细胞增生的弥漫性肾小球毛细血管基底膜增厚（A对）。微小病变性肾病光镜下肾小球基本正常，电镜下主要改变是脏层上皮细胞足突广泛融合，细胞肿胀（B对）。急进性肾炎主要是光镜下50％以上肾小球的肾小囊中有大新月体形成（C错，为本题正确答案）。急性链球菌感染后肾小球肾炎主要是弥漫增生性肾小球炎症，其病变特点是内皮细胞和系膜细胞增生（D对）。系膜增生性肾炎主要是系膜细胞及系膜基质不同程度的弥漫增生（E对）。